患者，女，35岁，已婚。月经后期，40〜50天一行，量少、色暗、时有血块，小腹较胀，乳房胀痛，舌略暗苔薄，脉弦。其证候是
A. 血寒
B. 血虚
C. 肾虚
D. 气滞
E. 血瘀

正确答案：D。气滞

解析：题中患者为月经后期，气机不畅，胞宫、血海不能按时满溢，故月经后期，40〜50天一行，量少。气滞则血液运行受阻，故时有血块，色暗。肝郁气滞则小腹较胀，乳房胀痛。舌略暗苔薄，脉弦为肝郁气滞之象，故辨为气滞证。月经后期血寒虚寒者小腹隐痛，喜暖喜按，小便清长，大便稀溏，实寒者小腹冷痛拒按，得热痛减，伴畏寒肢冷，面色青（A错）。月经后期血虚者小腹作痛绵绵，伴头晕眼花，心悸少寐，面色苍白或萎黄（B错）。月经后期肾虚证多伴腰膝酸软，头晕耳鸣，面色晦暗，无血块，无小腹胀和乳房胀痛（C错）。题中辨为气滞证（D对）。血瘀造成的为瘀阻冲任、子宫，经血难行，而致经期延长，不能导致月经后期（E错）。